为了减少胃黏膜刺激，出血，非甾体抗炎药美洛昔康宜于
A. 早晨服用
B. 餐中
C. 餐前
D. 睡前
E. 空腹

正确答案：B。餐中

解析：本题考查药品服用的适宜时间。非甾体抗炎药美洛昔康宜于餐中（B对）服用，不仅可减少胃黏膜出血几率，也可以使镇痛作用持久。适宜早晨（A错）服用的药有糖皮质激素类、抗高血压药、抗抑郁药、利尿等药。适宜餐前（C错）服用的药有胃黏膜保护药、收敛药、促胃动力药等。适宜睡前（D错）服用的药物有催眠药、平喘药、钙剂等。适宜空腹（E错）服用的药有钙磷调节药、抗菌药物和广谱抗线虫药。